在环境中较易自净的物质是
A. 有机氯农药
B. 镉
C. 多氯联苯
D. 碳氧化物
E. 汞

正确答案：D。碳氧化物

解析：本题考查在环境中较易自净的物质。在环境中较易自净的物质是碳氧化物（D对ABCE错）。碳氧化物是指只由碳与氧组成的化合物，最简单常见的碳氧化物包括一氧化碳（CO）和二氧化碳（CO₂）。